津液运行依靠气的
A. 推动作用
B. 固摄作用
C. 防御作用
D. 温煦作用
E. 气化作用

正确答案：A。推动作用

解析：气的推动作用指气的激发和推动功能，主要体现于：①激发和促进人体的生长发育与生殖功能（A对）。②激发和促进各脏腑经络的生理功能。③激发和促进精、血、津液的生成与运行（A对）。④激发和兴奋精神活动。气的固摄作用是指气对体内精、血、津液等物质具有防止其无故流失的作用（B错）；气的防御作用是指气有卫护机体、抗御邪气的作用（C错）；气的温煦作用是指阳气对人体各脏腑组织的机能活动，以及生命物质代谢具有温煦作用（D错）；气的气化作用指人体精、气、血、津液各自的代谢及其相互转化需要气的运动（E错）。